关于健康城市，正确的是
A. 从城市规划、建设到管理各个方面都以住宅为中心
B. 营造高质量的城市环境
C. 保障广大市民交通便利
D. 营造舒适的社区环境
E. 健康人群、健康环境和健康社会有机结合的人类社会发展整体

正确答案：E。健康人群、健康环境和健康社会有机结合的人类社会发展整体

解析：本题考查健康城市。健康城市是在城市规划、建设、管理、服务等各个方面都以健康为中心，营造高质量的自然环境和更加舒适的生活环境，保障市民健康的生活和工作，成为健康人群、健康环境和健康社会有机结合的人类社会发展整体（E对ABCD错）。